临床实践中，导致用药错误的因素不包括
A. 调配处方未执行双人核对
B. 对医务人员的培训缺失
C. 药物不良反应
D. 患者未能掌握药品的正确用法
E. 药品包装相似

正确答案：C。药物不良反应

解析：本题考查用药错误的原因。药品不良反应（C错，为本题正确答案）不属于导致用药错误的因素。产生用药错误的原因比较复杂，常见的错误原因可概括为四个方面。1.管理缺失（1）工作流程和环境的缺陷 如工作过于繁忙、环境嘈杂、常有电话打扰、药品位置凌乱、未执行双人核对制度（A对）、临时稀释药品、新手值班以及计算机医嘱系统缺陷（缺乏自动审方功能，不能适时提示用药禁忌）等。（2）培训缺失 医生、护士和药师对新购入药品的知识缺乏培训（B对），不了解新药的正确使用方法、注意事项和禁忌证等，造成用药错误。（3）患者教育欠缺 医生或药师缺乏足够的时间和耐心教育患者如何用药，患者对药品贮存条件、服用方法和时间、不良反应的对策和用药疗程等问题没有充分了解（D对）。造成患者教育欠缺的根本原因是管理不善。2.认知障碍。3.操作失误（行为因素）（1）沟通失误；（2）剂量计算错误；（3）给药时间、途径或剂型错误。4.其他因素（1）产品缺陷 药品标签和包装缺陷导致的用药错误占全部差错报告的20%左右。如包装外观相似的药品（E对）极易导致药师调配错误和护士发错药品；药品标签的浓度表示方法不当也是剂量错误的原因之一；同种药物的不同规格之间也常常引起用药剂量差错。（2）患者因素。